含镁、钙、铁金属离子的中药与左旋多巴联用能
A. 产生络合物，妨碍吸收
B. 产生或增加毒性
C. 产生沉淀，降低药物疗效
D. 抑制药物活性
E. 引发药源性肝炎

正确答案：A。产生络合物，妨碍吸收

解析：本题考查的是中西药不合理联用的例举。含镁、钙、铁金属离子的中药与左旋多巴联用能产生络合物，妨碍吸收（A对）。含钙、镁、铁等金属离子的中药或中成药，不能与左旋多巴联用，因左旋多巴中有游离酚羟基，与上述中药合用后，遇金属离子则会产生络合反应，生成左旋多巴与钙、铝、镁、铁、铋的络合物，影响其吸收，从而降低左旋多巴的生物效应。产生或增加毒性（B错）为含钙较多的中药或中成药与洋地黄类药物联用的效果。含钙较多的中药或中成药，如石膏、龙骨、牡蛎、珍珠、蛤壳及瓦楞子等，不可与洋地黄类药物合用，因钙离子为应激性离子，能增强心肌收缩力，抑制Na⁺，K⁺-ATP酶活性（也可以说与强心苷有协同作用），从而增强洋地黄类药物的作用和毒性。产生沉淀，降低药物疗效（C错）为含雄黄类的中成药与硫酸盐、硝酸盐、亚硝酸盐及亚铁盐类西药联用的效果。含雄黄类的中成药，不能与硫酸盐、硝酸盐、亚硝酸盐及亚铁盐类西药合服，因雄黄所含硫化砷具有氧化还原性，遇上述无机盐类后即生成硫化砷酸盐沉淀物，既阻止西药的吸收，又使含雄黄类的中成药失去原有的疗效，并有导致砷中毒的可能。抑制药物活性（D错）为金银花、连翘、黄芩、鱼腥草等及其中成药与菌类制剂如乳酶生、促菌生等联用的效果。金银花、连翘、黄芩、鱼腥草等及其中成药，不宜与菌类制剂如乳酶生、促菌生等联用，因金银花、连翘、黄芩、鱼腥草等及其中成药具有较强抗菌作用，服用后在抗菌的同时，还能抑制或降低西药菌类制剂的活性。引发药源性肝炎（E错）为含水合型鞣质而对肝脏有一定毒性中药及中成药与对肝脏有一定毒性的西药四环素、利福平、氯丙嗪、异烟肼、依托红霉素等联用的效果。含水合型鞣质而对肝脏有一定毒性的诃子、五倍子、地榆、四季青等，以及含有这些药物的中成药，不能与对肝脏有一定毒性的西药四环素、利福平、氯丙嗪、异烟肼、依托红霉素等联用，因联用后会加重对肝脏的毒性，导致药源性肝病的发生。